合成血红素的关键酶是
A. ALA合酶
B. 葡萄糖激酶
C. 丙酮酸激酶
D. HMG-CoA裂解酶
E. 异柠檬酸脱氢酶

正确答案：A。ALA合酶

解析：ALA合酶（A对）是合成血红素的关键酶，受多种因素的调节。在线粒体内，来自柠檬酸循环的琥珀酰CoA与甘氨酸在ALA合酶催化下缩合成ALA。葡萄糖激酶是肝细胞内存在的己糖激酶的Ⅳ型同工酶，催化葡萄糖磷酸化生成葡糖-6-磷酸，此反应不可逆，葡萄糖激酶（B错）是此反应的关键酶。丙酮酸激酶催化磷酸烯醇式丙酮酸将高能磷酸基转移给ADP生成ATP和丙酮酸，此反应不可逆，丙酮酸激酶（C错）是此反应的关键酶。HMG-CoA裂解酶（D错）催化HMG-CoA裂解产生乙酰乙酸。异柠檬酸脱氢酶催化异柠檬酸氧化脱羧转变为α-酮戊二酸，此反应不可逆，异柠檬酸脱氢酶（E错）是此反应的关键酶。